不属于拔牙术后医嘱的是
A. 饭后要刷牙保持口腔清洁
B. 避免患侧咀嚼
C. 不可反复吸吮创口
D. 勿用舌舔创口
E. 拔牙当日应进软食，不可过热

正确答案：A。饭后要刷牙保持口腔清洁

解析：拔牙术后医嘱：拔牙后24小时不可刷牙漱口。术后应避免进食过热食物及剧烈运动，并注意保持口腔卫生。避免患侧咀嚼，勿用舌舔创口，更不可反复吸吮。掌握“牙拔除术”知识点。